患者，男，65岁，诊断为高血压（2级），同时有哮喘病史，不宜选用的药物是
A. 普萘洛尔
B. 非洛地平
C. 卡托普利
D. 多沙唑嗪
E. 氢氯噻嗪

正确答案：A。普萘洛尔

解析：本题考查降压药的禁忌症。普萘洛尔（A对）为非选择性β受体阻断剂，可引起支气管痉挛，故禁用于哮喘患者。慢性阻塞性肺病、运动员、周围血管病或糖耐量异常者慎用。非洛地平（B错）为二氢吡啶类钙通道阻滞剂，没有绝对禁忌症，但心动过速与心力衰竭患者应慎用。卡托普利（C错）为ACEI类降压药，禁忌症为双侧肾动脉狭窄、高钾血症及妊娠期妇女。多沙唑嗪（D错）为α受体阻断剂，直立性低血压者禁用，心力衰竭者慎用。氢氯噻嗪（E错）属噻嗪类利尿药，痛风者禁用，高尿酸血症、明显肾功能不全者慎用。